性温，祛风除湿，舒筋活络的是
A. 秦艽
B. 木瓜
C. 伸筋草
D. 络石藤
E. 千年健

正确答案：C。伸筋草

解析：本题考查的是伸筋草的性味归经与功效。性温，祛风除湿，舒筋活络的是伸筋草（C对）。伸筋草：【性味归经】苦、辛，温。归肝经。【功效】祛风除湿，舒筋通络，活血消肿。秦艽（A错）：【性味归经】苦、辛，微寒。归胃、肝、胆、大肠经。【功效】祛风湿，舒筋络，清虚热，利湿退黄。木瓜（B错）：【性味归经】酸，温。归肝、脾经。【功效】舒筋活络，化湿和中，生津开胃。络石藤（D错）：【性味归经】苦，微寒。归心、肝经。【功效】祛风通络，凉血消肿。千年健（E错）：【性味归经】苦、辛，温。归肝、肾经。【功效】祛风湿，强筋骨。